医疗机构执业登记的主要事项不包括
A. 名称
B. 地址
C. 床位
D. 报价
E. 注册资金

正确答案：D。报价

解析：执业登记的事项医疗机构执业登记的主要事项是①类别、名称、地址、法定代表人或者主要负责人；②所有制形式；③注册资金（资本）；④服务方式；⑤诊疗科目；⑥房屋建筑面积、床位(牙椅)；⑦服务对象；⑧职工人数；⑨执业许可证登记号（医疗机构代码)等。门诊部、诊所、卫生所、医务室、卫生保健所、卫生站还应当核准附设药房(柜）的药品种类。掌握“医疗机构登记和校验及法律责任”知识点。